易泛油的饮片是
A. 麻黄
B. 芦荟
C. 白果
D. 何首乌
E. 千金子

正确答案：E。千金子

解析：本题考查的是中药饮片的贮藏要求。易泛油的饮片是千金子（E对）。易泛油饮片包括：独活、火麻仁、核桃仁、榧子、千金子、当归、牛膝、巴豆、狗肾、木香、龙眼肉、橘核、苦杏仁、蝼蛄、前胡、川芎、白术、苍术。易变色饮片包括：月季花、白梅花、玫瑰花、款冬花、红花、山茶花、金银花、扁豆花、橘络、佛手、通草、麻黄（A错）。易软化融化类饮片包括：松香、芦荟（B错）、阿魏、猪胆膏、白胶香、安息香、柿霜、乳香、没药、苏合香。易发霉饮片包括：天冬、牛膝、独活、玉竹、黄精、白果（C错）、橘络、全瓜蒌、山茱萸、莲子心、枸杞子、大枣、马齿苋、大蓟、小蓟、大青叶、桑叶、哈蟆油、鹿筋、狗肾、水獭肝、蛤蚧、黄柏、白鲜皮、川槿皮、人参、党参、当归、知母、紫菀、菊花、红花、金银花、白及、木香、五味子、洋金花、蝼蛄、地龙、蕲蛇、蜈蚣、甘草、葛根、山柰、青皮、芡实、薏苡仁、栀子、羌活、黄芩、远志。何首乌（D错）属于易生虫饮片。